个性结构理论认为哪几部分保持平衡状态有利于人格正常发展
A. 本我、自我和超我
B. 本我、自我和现实
C. 自我和现实
D. 本我和自我
E. 本我和超我

正确答案：A。本我、自我和超我